牙齿结构异常包括
A. 釉质发育不全
B. 乳光牙本质
C. 氟斑牙
D. 四环素牙
E. 以上都是

正确答案：E。以上都是

解析：本题考查牙齿结构异常。釉质发育不全指在牙发育期间，由于全身疾患、营养障碍或严重的乳牙根尖周感染导致釉质结构异常（A对）。遗传性乳光牙本质属于遗传性在牙本质障碍，是牙本质结构异常（B对）。氟斑牙（氟牙症或斑釉）是氟损害釉质发育期牙胚的成釉细胞而造成的釉质发育不良（C对）。四环素牙为四环素作用于牙齿造成的着色及釉质发育不全（D对）。（ABCD均对，故E为本题的正确答案）。